女婴，1个月，出生史42周+3，出生后母乳喂养，吮吸及喂养差，腹胀便秘，少哭且哭声低，体重4.1kg，皮肤轻度黄染，脐膨隆，肌张力低。其最有可能的诊断为
A. 先天性甲状腺功能减退症
B. 骨软骨发育不良
C. 黏多糖贮积病
D. 唐氏综合征
E. 先天性巨结肠

正确答案：A。先天性甲状腺功能减退症

解析：患者女婴，1个月，出生史42周+3，出生后母乳喂养，吮吸及喂养差，腹胀便秘，少哭且哭声低，体重4.1kg，皮肤轻度黄染，脐膨隆，肌张力低（先天性甲状腺功能减退症的表现），结合患儿的临床表现，最诊断为先天性甲状腺功能减退症（A对）。骨骼发育障碍的疾病如骨软骨发育不良、黏多糖病等都有生长迟缓症状，骨骼X线片和尿中代谢物检查可资鉴别（B错）。黏多糖贮积病（MPS）是一组因黏多糖降解酶缺乏的疾病，使酸性黏多糖不能完全降解，导致黏多糖积聚在机体不同组织，产生骨骼畸形、智能障碍、肝脾增大等一系列临床症状和体征（C错）。唐氏综合征 本病主要特征为智能落后、特殊面容和生长发育迟缓并可伴有多种畸形（D错）。先天性巨结肠 凡新生儿生后胎粪排出延迟或不排胎粪，伴有腹胀、呕吐应考虑本病（E错）。以上四种疾病未出现少哭且哭声低、脐膨隆等先天性甲状腺功能减退症的表现，故除外。